严禁使用全病毒流感疫苗的人群是
A. 10岁及以下儿童
B. 11岁及以下儿童
C. 12岁及以下儿童
D. 12岁以上人群
E. 18岁以上人群

正确答案：C。12岁及以下儿童